以X线检查结果作为重要诊断依据的牙髓炎是
A. 可复性牙髓炎
B. 急性牙髓炎
C. 慢性牙髓炎
D. 牙髓钙化
E. 牙髓坏死

正确答案：D。牙髓钙化

解析：本题考查牙髓钙化的诊断要点。牙髓钙化（D对）时X线片显示髓腔内有阻射的钙化物（髓石）或呈弥散性阻射影像而使原髓腔处的透射区消失，因此牙髓钙化可以以X线检查结果作为重要诊断依据。软组织在X线片上不显影，牙髓属于软组织，在X线片上无影像，所以可复性牙髓炎（A错）、急性牙髓炎（B错）、慢性牙髓炎（C错）、牙髓坏死（E错）X线髓腔影像与正常牙无区别。